对于戊型肝炎，以下哪一项是错误的
A. 其病原体为HEV
B. 以粪-口传播途径为主
C. 经水传播常引起暴发流行
D. 孕产妇的发病率、病死率均高
E. 无明显的季节性

正确答案：E。无明显的季节性